少年人口数为100时，相对应的老年人口数是指
A. 老年人口系数
B. 少年人口系数
C. 老龄化指数
D. 总抚养比
E. 老年人口抚养比

正确答案：C。老龄化指数